小儿生长发育，下述哪项是错误的是
A. 生长发育是连续的过程，有阶段的过程
B. 各系统的发育遵循一定的规律
C. 淋巴系统发育于青春期达高峰
D. 不同年龄段生长速度不同
E. 生长发育是按一定规律进行的，无个体差异

正确答案：E。生长发育是按一定规律进行的，无个体差异

解析：生长发育是一连续的、有阶段性的过程；各系统、器官的生长发育不平衡，小儿各系统的发育快慢不同，各有先后。如神经系统发育是先快后慢，生殖系统发育是先慢后快，体格发育是快慢快，淋巴系统发育在儿童期较迅速，青春期达高峰，以后降至成人水平。生长发育的个体差异；生长发育虽有一定的规律性，但受一些因素（如性别、遗传、内分泌、环境、教养、营养、疾病等）影响存在着相当大的个体差异，个体差异一般随年龄增长而显著，青春期差异更大。掌握“小儿生长发育规律”知识点。